两药合用，一种药物的毒副作用能被另一种药物所抑制的配伍关系，称为
A. 相使
B. 相杀
C. 相畏
D. 相反
E. 相恶

正确答案：C。相畏

解析：该题主要考查中药“七情”配伍理论。相畏即一种药物的毒副作用能被另一种药物所抑制（C对）。